内毒素的主要成分
A. 肽聚糖
B. 蛋白质
C. 脂蛋白
D. 核酸
E. 脂多糖

正确答案：E。脂多糖

解析：掌握“医院感染及细菌的致病性”知识点。